小儿所需的热量，除了基础代谢所需外，还包括
A. 活动所需
B. 排泄的消耗
C. 生长发育所需
D. 食物的特殊动力作用
E. 以上都是

正确答案：E。以上都是

解析：小儿能量的需要分五个方面基础代谢、生长发育、食物的热力作用（食物的特殊动力作用）、活动所需和排泄损失的能量（E对）。